根据《药品经营质量管理规范》，药品零售企业中药饮片装斗前应
A. 质量审核
B. 专柜存放
C. 质量复核
D. 抽样检验
E. 抽样送检

正确答案：C。质量复核

解析：本题考查的是药品零售企业药品陈列要求。根据《药品经营质量管理规范》，药品零售企业中药饮片装斗前应质量复核（C对）。药品零售企业药品陈列要求：中药饮片柜斗谱的书写应当正名正字；装斗前应当复核，防止错斗、串斗；应当定期清斗，防止饮片生虫、发霉、变质；不同批号的饮片装斗前应当清斗并记录。